常见的乳磨牙早失的原因是
A. 外伤
B. 先天缺失
C. 严重的根尖周病变
D. 局限的牙髓炎
E. 牙列拥挤

正确答案：C。严重的根尖周病变

解析：本题考查乳磨牙早失的原因。常见的乳磨牙早失的原因是严重的根尖周病变（C对）。外伤（A错）较少伤及后牙；先天性缺失（B错）较少见；局限性牙髓炎（D错）较少引起乳磨牙缺失；牙列拥挤（E错）也不会造成乳磨牙缺失。因此选严重的根尖周病变导致牙槽骨的吸收从而导致乳磨牙的缺失。